根据《药品经营质量管理规范实施细则》，下列叙述错误的是
A. 跨地域连锁经营的零售连锁企业质量管理工作负责人，应是执业药师
B. 药品零售连锁企业应设置单独的、便于配货活动展开的配货场所
C. 药品零售连锁门店根据销售情况独立购进常用药品
D. 药品零售企业对陈列的药品按月进行检查
E. 药品零售企业的中药饮片应符合炮制规范，并做到计量准确

正确答案：C。药品零售连锁门店根据销售情况独立购进常用药品

解析：本题考查的是药品零售连锁企业总部药品经营活动。药品零售连锁企业总部负责对购进药品、供货单位及其销售人员的合法资质进行审核，并统一采购药品（C错，为本题正确答案）。药品零售连锁企业总部应当对所属零售门店建立统一的质量管理体系，在计算机系统、采购配送、票据管理、药学服务等方面统一管理。药品零售连锁企业总部的经营活动，应当执行药品批发企业管理的相关要求。药品零售连锁企业总部负责对购进药品、供货单位及其销售人员的合法资质进行审核，并统一采购药品。